5岁男童，因双侧耳前反复肿胀就诊。腮腺部扪诊可见导管口有脓液或胶冻状液体分泌，其镜下的病理表现为
A. 唾液腺导管扩张，导管内形成淋巴滤泡，小叶内导管上皮鳞状化生
B. 腺泡萎缩，结缔组织玻璃样变，导管上皮鳞状化生
C. 腺泡细胞坏死，导管上皮水肿
D. 小叶内导管扩张，上皮增生，淋巴滤泡形成，腺泡细胞萎缩
E. 腺泡萎缩、消失而为增生的结缔组织代替

正确答案：D。小叶内导管扩张，上皮增生，淋巴滤泡形成，腺泡细胞萎缩

解析：慢性复发性腮腺炎以3～6岁儿童多见。临床进行腮腺部位的扪诊可见导管口流出胶冻状液体。镜下见小叶内导管囊状扩张，导管上皮增生，囊壁为一至数层扁平上皮，囊腔可融合；附近导管周围有淋巴细胞浸润或形成淋巴滤泡；腺泡细胞萎缩。唇腺活检表现为腺体萎缩，间质中淋巴细胞浸润。掌握“慢性唾液腺炎的病理变化”知识点。